根据《中华人民共和国药品管理法》，医疗保险定点医疗机构应当按照规定如实公布其
A. 常用药品价格
B. 药品价格清单
C. 药品招标价格
D. 药品零售价格
E. 药品购销价格

正确答案：A。常用药品价格

解析：本题考查药品经营者遵守药品价格管理的规定。根据《中华人民共和国药品管理法》，医疗保险定点医疗机构应当按照规定如实公布其常用药品价格（A对）。药品经营者应如实报告销售和价格情况：药品上市许可持有人、药品生产企业、药品经营企业和医疗机构应当依法向药品价格主管部门提供其药品的实际购销价格（E错）和购销数量等资料。医疗机构应当向患者提供所用药品的价格清单（B错），按照规定如实公布其常用药品的价格，加强合理用药管理。及时发布药物相关信息，将不同类型的药品价格进行归类公示，让公众进行筛选。药品经营者合理定价明码标价：依法实行市场调节价的药品，药品上市许可持有人、药品生产企业、药品经营企业和医疗机构应当按照公平、合理和诚实信用、质价相符的原则制定价格，为用药者提供价格合理的药品；应当遵守国务院药品价格主管部门关于药品价格管理的规定，制定和标明药品零售价格（D错），禁止暴利、价格垄断和价格欺诈等行为。